血管性痴呆最常见的类型是
A. 多发梗死性痴呆
B. 单发梗死性痴呆
C. 特殊部位梗死性痴呆
D. 皮质下动脉硬化性脑病
E. 中毒性脑病

正确答案：A。多发梗死性痴呆

解析：血管性痴呆（VaD）是指缺血性、出血性脑血管疾病引起的脑损害所致的痴呆。多发性梗死性痴呆是VaD的最常见类型（A对），是在多次脑缺血基础上变化而来，因此，其主要病因为动脉粥样硬化、动脉狭窄和脑梗死。所以单发梗死性痴呆（B错），特殊部位梗死性痴呆（C错）不是最常见的。皮质下动脉硬化性脑病（D错）与血管性脑病有不同，它又称为皮质下动脉粥样硬化病，表现为进展性痴呆，步态不稳和小便失禁，无失用和失认，可用CT和MRI进行鉴别。中毒性脑病（E错）常发生在中毒性痢疾、败血症、重症肺炎等严重感染的极期。